头痛部位在两侧，连及耳部，是何经头痛
A. 少阴经
B. 厥阴经
C. 少阳经
D. 阳明经
E. 太阳经

正确答案：C。少阳经

解析：头为诸阳之会，手足三阳经均循头面，厥阴经亦上会于巅顶，由于受邪之脏腑经络不同，头痛之部位亦不同。大抵太阳头痛，在头后部，下连于项（E错）；阳明头痛，在前额部及眉棱骨等处（D错）；少阳头痛，在头之两侧，并连及于耳（C对）；厥阴头痛则在巅顶部位，或连目系（B错）。少阴经头痛没有明显定位特点(A错)。